不属于医生义务的内容是
A. 承担诊治的义务
B. 解释说明的义务
C. 保密的义务
D. 对社会的义务
E. 医学科研的义务

正确答案：E。医学科研的义务

解析：（1）医师对患者的义务：第一，遵守法律、法规，遵守技术操作规范；第二，树立敬业精神，遵守职业道德，履行医师义务，尽职尽责为患者服务；第三，关心、爱护、尊重患者，保护患者的隐私；第四，努力钻研业务，更新知识，提高专业技术水平；第五，宣传卫生保健知识，对患者进行健康教育。此外，还包括：不得拒绝急救处置；在履行告知义务时，应避免对患者产生不利后果；不得利用职务之便获取不正当利益等。（2）医师对社会的义务：医师对社会的义务是传统义务概念的延伸和拓展，具体包括：开展预防保健的义务。主动宣传普及医药卫生知识，提高公众自我保健和预防疾病的能力；支持和参与卫生防疫和环境治理活动等。第二，提高人类生命质量的义务。积极开展医学遗传咨询和优生优育宣传教育及计划免疫工作，提高人类健康素质；开展关爱生命与临终关怀的教育工作，促进社会的文明和进步。第三，参加社会现场急救的义务。对突发性的自然灾害以及工伤、车祸等意外事故，在需要时医师应立即奔赴现场，尽力抢救；在遇到传染病暴发或流行时，要服从组织的统一安排，积极投身防治现场和医疗第一线等。第四，发展医学科学事业的义务。医师应刻苦钻研新理论、新知识、新技术，具有献身和求实的精神，为促进医学科学的进步而努力（E错，为本题正确答案）。